在程序控制温度下，测量待测物质与参比物质的温度差（ΔT）与温度（或时间）关系的一种技术称为
A. 热重法
B. 差热分析法
C. 差示扫描量热法
D. 重量分析法
E. 差示分光光度法

正确答案：B。差热分析法